男，49岁。拟行甲状腺癌根治术。既往有2型糖尿病病史10余年，平素糖尿病饮食，长期口服短效降糖药控制血糖。术前正确的处理措施是
A. 提前1天改服长效降糖药物
B. 提前1周换用普通胰岛素
C. 服用降糖药物至手术前一天晚上
D. 提前3天换用普通胰岛素
E. 术中皮下注射胰岛素

正确答案：C。服用降糖药物至手术前一天晚上

解析：糖尿病人在整个围手术期都处于应激状态，在术前应该进行严格的评估和控制：对于症状较轻，仅以饮食控制的病人，无需特殊处理；口服降糖药的病人，应继续服用至手术的前一天晚上（C对），如服用的是长效降糖药，应该在术前2-3天停用；用胰岛素控制的病人，应该于手术当天早上停用。